一位36岁妇女，到医院进行孕前咨询，了解生唐氏综合征孩子的概率，医生经过咨询告知可能发生的概率是
A. 1/10000
B. 1/5000
C. 1/900
D. 1/800
E. 1/40

正确答案：D。1/800

解析：本题考查优生咨询中的常见遗传性疾病。21-三体（唐氏综合征）：最常见的染色体异常疾病，总发生率是新生儿活胎的1/800（D对ABCE错），其发生率与母体年龄密切相关，临床表现多种多样，其中以特殊面容（鼻梁低、眼距宽、伸舌）、通贯掌和智力发育障碍最为突出。